导致血浆HC03增多的原因中例外的是
A. 大量胃液引流
B. 肾上腺皮质功能低下
C. 低钾血症
D. Cushing综合症
E. 过度使用髓袢利尿剂

正确答案：B。肾上腺皮质功能低下

解析：大量胃液引流（A对）导致酸性物质丢失过多；低钾血症（C对）引起细胞外的 H向细胞内移动；使用髓袢利尿剂（E对）抑制肾髓袢升支对Cl-的主动重吸收，导致H+经肾大量丢失使HC03-大量被重吸收；Cushing综合症（D对）导致糖皮质激素过多；肾上腺皮质功能过多（B错，为本题正确答案）导致醛固酮促进集合管泌氢都可以导致血浆HC03增多